结核性骨髓炎说法错误的是
A. 可形成脓肿
B. 无死骨形成
C. 可见大量的中性粒细胞
D. 结节中心常见干酪样坏死
E. 镜下见骨髓腔内形成结核性肉芽组织

正确答案：B。无死骨形成

解析：本题考查结核性骨髓炎及放射性骨髓炎。镜下见骨髓腔内形成结核性肉芽组织，由上皮样细胞、朗汉斯巨细胞以及散在炎症细胞聚集形成所谓上皮样细胞结节。结节中心常见干酪样坏死，周围可见增生的纤维结缔组织。有时可见死骨形成（B错，为本题正确答案）。若继发一般化脓性感染时，除淋巴细胞浸润外，还可见大量的中性粒细胞，有时可形成脓肿。